诊断冠心病心绞痛最常用的非创伤性检查方法是
A. 休息时心电图
B. 24小时动态心电图
C. 心电图运动负荷试验
D. 超声心动图
E. 心脏CT检查

正确答案：C。心电图运动负荷试验